下列有关甲型肝炎的论述中，哪一项是不正确的
A. 未发现慢性带菌者
B. 潜伏期末已有传染性
C. 呈周期性
D. 无季节性
E. 感染早期即可测出抗甲型肝炎抗原的抗体

正确答案：D。无季节性